苦杏仁苷被酸水解后生成
A. 乙醇
B. 丙酮
C. 苯甲醛
D. 乙酸乙酯
E. 氢氰酸

正确答案：C、E。苯甲醛；氢氰酸

解析：本题考查的是苦杏仁苷的酸水解。苦杏仁苷被酸水解后生成苯甲醛（C对）和氢氰酸（E对）。苦杏仁苷是一种氰苷，易被酸和酶所催化水解。水解所得到的苷元α-羟基苯乙腈很不稳定，易分解生成苯甲醛和氢氰酸。其中苯甲醛具有特殊的香味。通常将此作为鉴别苦杏仁苷的方法。其具体操作为：取本品数粒，加水共研，发生苯甲醛的特殊香气。